健康管理发展的基础是
A. 个体临床预防服务
B. 个体临床服务
C. 个体预防服务
D. 个体康复服务
E. 个体护理服务

正确答案：A。个体临床预防服务

解析：本题考查健康管理发展的基础。健康管理是在个体临床预防服务（A对BCDE错）基础上发展起来的。